补中益气汤和参苓白术散两方中均含有的药味是
A. 当归、陈皮
B. 白术、人参
C. 山药、升麻
D. 茯苓、桔梗
E. 黄芪、甘草

正确答案：B。白术、人参

解析：本题考查方剂的组成。补中益气汤和参苓白术散两方中均含有的药味是白术、人参（B对）。